关于对批准生成的新药品种设立监测期规定的说法，错误的是
A. 药品生产企业应当经常考察处于监测期内新药的生产工艺
B. 新药的监测期自新药批准生产之日起计算，最长不得超过5年
C. 监测期内的新药，国家药品监督管理部门不得批准其他企业进口该药的申请
D. 监测期内的新药应根据临床应用分级管理制度限制使用

正确答案：D。监测期内的新药应根据临床应用分级管理制度限制使用

解析：本题考查药品监测期的规定。关于对批准生成的新药品种设立监测期规定的说法，错误的是监测期内的新药应根据临床应用分级管理制度限制使用（D错，为本题正确答案）。《药品不良反应报告和监测管理办法》第四章药品重点监测第四十一条：药品生产企业应当经常考察本企业生产药品的安全性（A对），对新药监测期内的药品和首次进口5年内的药品，应当开展重点监测，并按要求对监测数据进行汇总、分析、评价和报告；对本企业生产的其他药品，应当根据安全性情况主动开展重点监测。《中华人民共和国药品管理法实施条例》第五章药品管理第三十三条国务院药品监督管理部门根据保护公众健康的要求，可以对药品生产企业生产的新药品种设立不超过5年的监测期（B对）；在监测期内，不得批准其他企业生产和进口（C对）。抗菌药物临床应用实行分级管理。